男，35岁，1周来乏力发热伴牙龈肿胀出血。化验Hb65g/L，WBC30×10⁹/L，分类见原幼细胞30%，Plt35×10⁹/L，，骨髄检查原始细胞80%，POX染色部分呈弱阳性，非特异性酯酶染色阳性，NaF可抑制。该例急性白血病最可能的FAB分型是
A. M1型
B. M2型
C. M3型
D. M4型
E. M5型

正确答案：E。M5型

解析：患者已诊断为急性白血病，骨髄检查原始细胞80%（原始细胞≥30%可诊断为急性白血病），POX染色部分呈弱阳性，非特异性酯酶染色阳性，NaF可抑制（符合急性单核细胞白血病细胞化学染色特点），故该患者最可能的FAB分型是急性单核细胞白血病（M₅）（E对）。M₁型（A错）原始细胞90%以上，POX染色至少3%以上的细胞阳性，非特异性酯酶染色阳性，NaF不能抑制；M₂型（B错）、M₃型（C错）POX染色呈强阳性，非特异性酯酶染色阳性，NaF不能抑制；M₄型（D错）POX染色可呈阳性，非特异性酯酶染色阳性，NaF不能抑制。